急性龋深龋洞不能去净全部腐质，但是牙髓情况良好，无明显症状，则应该首先进行的是
A. 安抚
B. 垫底充填
C. 间接盖髓术
D. 直接盖髓术
E. 根管治疗术

正确答案：C。间接盖髓术

解析：本题考查龋病的治疗原则与非手术治疗方法。急性深龋洞洞底软龋不能去净，但是牙髓情况良好，无明显敏感，疼痛等症状，则先行间接盖髓术（C对），隔段时间检查无明显症状后，再进行垫底充填。